维生素C可促进哪种蛋白质在体内的合成
A. 肌纤维蛋白
B. 糖蛋白
C. 黏蛋白
D. 胶原蛋白
E. 肌红蛋白

正确答案：D。胶原蛋白